劳动1分钟需要的氧量称为
A. 氧需
B. 氧债
C. 乳酸氧债
D. 非乳酸氧债
E. 最大摄氧量

正确答案：A。氧需